下列对胃脾韧带的描述何者正确
A. 连于胃底和脾门之间
B. 为单层腹膜结构
C. 含胃左血管
D. 含胃网膜右血管起始段
E. 含脾动、静脉

正确答案：A。连于胃底和脾门之间

解析：胃脾韧带连于胃底和脾门之间(A对)，为双层腹膜结构(B错)，含胃短血管、胃网膜左血管及淋巴管、淋巴结，不含胃左血管(C错)，胃网膜右血管(D错)，脾动、静脉(E错)。